某男，72岁。患肠燥便秘与燥咳痰稠，医师在方中处以瓜蒌仁，此因该药的功效是
A. 润肠通便，补虚
B. 润肠通便，润肺化痰
C. 润肠通便，降气化痰
D. 润肠通便，凉血止血
E. 润肠通便，利水消肿

正确答案：B。润肠通便，润肺化痰

解析：本题考查的是瓜蒌仁的功效。患肠燥便秘与燥咳痰稠，医师在方中处以瓜蒌仁，此因该药的功效是润肺化痰，滑肠通便（B对）。瓜蒌：【功效】清肺润燥化痰，利气宽胸，消肿散结，润肠通便。瓜蒌皮长于清肺化痰，利气宽胸；瓜蒌仁长于润肺化痰，滑肠通便；全瓜蒌兼具两者功效。紫苏子：【功效】降气化痰，止咳平喘，润肠通便（C错）。郁李仁：【功效】润肠通便，利水消肿（E错）。功效为润肠通便，补虚（A错）或润肠通便，凉血止血（D错）的中药，2022年考试指南未明确说明。